男，40岁。痰中带血1个月，乏力、头晕1周。实验室检查：血钠114mmol/L，补钠治疗效果欠佳。胸部X线片检查发现右肺门团块状影4cm×4cm。纤维支气管镜检查示右主支气管黏膜粗糙水肿，管腔狭窄，黏膜活检可见肿瘤细胞。最可能的病理类型是
A. 大细胞瘤
B. 腺癌
C. 类癌
D. 小细胞癌
E. 鳞癌

正确答案：D。小细胞癌

解析：男，40岁。痰中带血1个月，乏力、头晕1周。实验室检查：血钠114mmol/L，补钠治疗效果欠佳（考虑副癌综合征，以小细胞肺癌多见）。胸部X线片检查发现右肺门团块状影4cm×4cm。纤维支气管镜检查示右主支气管黏膜粗糙水肿，管腔狭窄，黏膜活检可见肿瘤细胞（小细胞肺癌常局限性发生于大支气管，浸润支气管壁，造成管腔狭窄）。根据病史、临床表现、辅助检查，最可能的诊断为小细胞癌（D对）。鳞癌（E错）与吸烟关系密切，虽也多表现为中央型肺癌，但副癌综合征以小细胞肺癌多见。腺癌（B错）：近年来发病率上升明显，已超越鳞癌成为最常见的肺癌。发病年龄普遍低于鳞癌和小细胞肺癌，多为周围型，一般生长较慢，但有时在早期即发生血行转移，淋巴转移较晚。旧称的细支气管肺泡癌是腺癌的一种特殊类型，起源于肺泡上皮，影像学呈特征的磨砂璃样病灶，显微镜下见癌细胞沿细支气管、肺泡管和肺泡壁生长，不侵犯肺间质。大细胞癌（A错）相对少见，与吸烟有关，老年男性、周围型多见。